女，25岁。咽部不适、声音嘶哑半年，伴反酸、烧心，偶有干咳，无咳痰，无发热，无腹痛、腹泻、呕血、黑便。查体：T36.5℃，P80次/分，R18次/分，BP120/80mmHg。咽部慢性充血。双肺呼吸音清，未闻及干湿性啰音，心律齐。腹软。最适当的治疗是
A. 雾化吸入糖皮质激素
B. 口服胃黏膜保护剂
C. 口服抗组胺药物
D. 口服质子泵抑制剂
E. 应用抗生素

正确答案：D。口服质子泵抑制剂

解析：患者反酸、烧心（GERD典型症状），咽部不适、声音嘶哑，偶有干咳，咽部慢性充血（GERD反流的食管外症状）。因此最可能诊断为GERD。最适当的治疗是口服质子泵抑制剂（D对）。